金属烤瓷冠的制作，错误的说法是
A. 全冠舌侧颈缘全用金属
B. 金瓷结合处应避开咬合功能区
C. 金瓷结合处呈斜面搭接
D. 瓷覆盖区底层冠厚度至少0.5mm
E. 瓷覆盖区瓷层空间不超过2mm

正确答案：C。金瓷结合处呈斜面搭接

解析：本题考查金属烤瓷冠的制作。完成线应保证金属支撑面积，使金-瓷呈对接形式（C错，为本题正确答案）。金属烤瓷冠舌侧不涉及美观问题，全冠舌侧颈缘可全用金属（A对）。金瓷结合处容易发生强度问题，如瓷崩裂或折断，因此金瓷结合处应避开咬合功能区（B对）。在正常咬合力下，非贵金属的厚度在0.5mm以上足够了，因此瓷覆盖区底层冠厚度至少0.5mm（D对）。瓷覆盖区瓷层厚度太厚，会发生崩瓷，故瓷覆盖区瓷层空间不超过2mm（E对）。